属于药物经济学中所讲的间接成本的是
A. 医疗费用
B. 伤病期间造成的工资损失
C. 精神上的痛苦
D. 疾病引起的疼痛
E. 生活的不便

正确答案：B。伤病期间造成的工资损失

解析：本题考查药物经济学的基本概念。间接成本是指由于患者伤病或死亡所造成的工资损失（B对）。